对胎儿及母体均无明显影响，也无致畸作用，妊娠期感染时可选用的药品是
A. 左氧氟沙星
B. 氯霉素
C. 磷霉素
D. 万古霉素
E. 甲硝唑

正确答案：C。磷霉素

解析：本题考查妊娠期抗菌药物的应用。药毒性低，对胎儿及母体均无明显影响，妊娠期感染时可选用：青霉素类、头孢菌素类和磷霉素（C对）等。对胎儿有致畸或明显毒性作用：如四环素类、喹诺酮类等。对母体和胎儿均有毒性作用：如氨基糖苷类、万古霉素等。